治疗内伤发热属阴虚内热证候者，首选方剂为
A. 六味地黄丸
B. 二至丸
C. 清骨散
D. 青蒿鳖甲散
E. 大补阴丸

正确答案：C。清骨散

解析：阴虚发热证之内伤发热是因阴虚阳盛，虚火内炽导致的，治疗应首选清骨散滋阴清热（C对）。六味地黄丸滋阴固肾，为肾阴亏虚之消渴的代表方（A错）。二至丸补益肝肾，滋阴补血，主治肝肾阴虚，眩晕耳鸣，咽干鼻燥，腰膝酸痛，月经量多（B错）。青蒿鳖甲散清补相煎，主治五阴虚耗（D错）。大补阴丸滋阴降火，主治阴虚火旺证（E错）。